某工厂排放废水量为3000kg/d，其中镉浓度为0.6mg/L，镉的排放标准为0.1mg/L。镉的等标污染负荷为
A. 0.14
B. 0.15
C. 0.16
D. 0.17
E. 0.18

正确答案：E。0.18

解析：本题考查等标污染负荷。等标污染负荷是把i污染物的排放量稀释到其相应排放标准时所需的介质量，用以评价各污染源和各污染物的相对危害程度。其计算式为：Pi＝mi/Ci，式中：Pi为i污染物的等标污染负荷；mi为i污染物的排放量，kg/d；Ci为i污染物的浓度排放标准，mg/L或mg/m³。本题某工厂排放废水量为3000kg/d，镉浓度为0.6mg/L，镉的排放标准为0.1mg/L。镉的等标污染负荷为0.18（E对ABCE错）。